在设计突发环境污染事件综合安全管理配套制度时，其依据的基础是
A. 风险
B. 规模
C. 资金
D. 设施
E. 政策

正确答案：A。风险

解析：本题考查在设计突发环境污染事件综合安全管理配套制度时，其依据的基础。在设计突发环境污染事件综合安全管理配套制度时，其依据的基础是风险（A对BCDE错）。